“中正之官”指的是
A. 胆
B. 胃
C. 小肠
D. 三焦
E. 膀胱

正确答案：A。胆

解析：胆主决断，指胆具有对事物进行判断、做出决定的功能（A对）。胃为太仓、水谷之海（B错）。小肠主受盛化物（C错）。“三焦者，决渎之官，水道出焉”（D错）。“膀胱者，州都之官，津液藏焉”（E错）。